患者，女，65岁，间断腹胀、纳差6年，因病情加重伴精神恍惚3天为主诉入院，实验室检查：ALT200U/L，AST320U/L，诊断为肝硬化失代偿期、肝性脑病。患者乙肝病史20年，间断服用中药（具体不详）治疗。糖尿病史10年，便秘多年，3～4天排便一次。可为该患者选择的保肝降酶药物是
A. 水溶性维生素
B. 多烯磷脂酰胆碱
C. 辅酶A
D. 维生素B₁
E. 谷维素

正确答案：B。多烯磷脂酰胆碱

解析：本题考查保肝降酶药。可为该患者选择的保肝降酶药物是多烯磷脂酰胆碱（B对）。抗炎保肝治疗药物包括维生素及辅酶类（水溶性维生素（A错）、辅酶A（C错））、保肝降酶类（水飞蓟素（宾）、双环醇、多烯磷脂酰胆碱、甘草酸二铵、还原性谷胱甘肽、S-腺苷蛋氨酸、熊去氧胆酸等）、解毒保肝类（谷胱甘肽、葡醛内酯）。